月经的第24～28天，称为
A. 月经期
B. 增殖期
C. 分泌期
D. 分泌晚期
E. 月经周期

正确答案：D。分泌晚期

解析：分泌期晚期：月经周期第24～28日。月经周期第24～28日。此期为月经来潮前期，相当于黄体退化阶段。掌握“女性生殖系统生理”知识点。